人参皂苷是
A. 甾体皂苷
B. 蒽醌苷
C. 强心苷
D. 黄酮苷
E. 三萜皂苷

正确答案：E。三萜皂苷

解析：本题考查人参的化学成分。人参皂苷是三萜皂苷（E对）。人参含有皂苷、多糖和挥发油等多种化学成分，人参皂苷为人参的主要有效成分之一。人参皂苷可以分为三类，分别是人参皂苷二醇型（A型）、人参皂苷三醇型（B型）和齐墩果烷型（C型）。含甾体皂苷（A错）类化合物麦冬：主要包括麦冬皂苷A、麦冬皂苷B等。含蒽醌（B错）类化合物虎杖：主要含有蒽醌类化合物，此外还含有二苯乙烯类、黄酮类、水溶性多糖和鞣质等成分。蒽醌类成分包括大黄素、大黄酚、大黄酸等。含强心苷（C错）类化合物香加皮：含有的强心苷类化合物为甲型强心苷，其中杠柳毒苷和杠柳次苷为其主要成分。含黄酮苷（D错）类化合物葛根：葛根含异黄酮类化合物，主要成分有大豆素、大豆苷、大豆素-7，4’-二葡萄糖苷及葛根素、葛根素-7-木糖苷。